在医院外部罹患的感染性肺实质炎症，称为
A. 社区获得性肺炎
B. 医院获得性肺炎
C. 医院内肺炎
D. 肺炎链球菌肺炎
E. 结核性肺炎

正确答案：A。社区获得性肺炎

解析：社区获得性肺炎（CAP）是指在医院外罹患的感染性肺实质炎症，包括具有明确潜伏期的病原体感染而在入院后平均潜伏期内发病的肺炎。掌握“肺炎”知识点。